经行头痛的治法是
A. 补益精血
B. 温经泻火
C. 调理气血，通经活络
D. 补益肝肾
E. 解表清里

正确答案：C。调理气血，通经活络

解析：经行头痛的主要治法为调理气血，通经活络（C对）。经行头痛主要与气血失和，要调和气血，不单纯补益精血（A错）。经行头痛主要有肝火证、血瘀证、血虚证，无寒证（B错）。经行头痛肝火旺，应清热平肝熄风，而不是补益肝肾（D错）。经行头痛属内伤头痛，不属外感头痛（E错）。